引起肾性急性肾衰竭最常见的原因是
A. 间质性肾炎
B. 肾结核
C. 肾缺血和再灌注损伤
D. 尿路梗阻
E. 肾小动脉硬化

正确答案：C。肾缺血和再灌注损伤

解析：引起肾性急性肾衰竭最常见的原因是肾缺血和再灌注损伤（C对）。